可用氢氟酸溶液酸蚀断面，增加树脂材料的固位的指
A. 修复体脱落
B. 穿孔金属修复体
C. 折断牙冠部分的桩
D. 烤瓷冠大范围破损崩瓷
E. 前牙烤瓷冠局部崩瓷缺损

正确答案：E。前牙烤瓷冠局部崩瓷缺损

解析：前牙烤瓷冠局部崩瓷缺损，可用氢氟酸溶液酸蚀断面，冲洗吹干后，在口内添加光固化复合树脂恢复外形，也可在瓷层做小的固位洞形，以增加树脂材料的固位。掌握“修复体戴入后的问题及处理”知识点。